下列疾病，立位X线透视可见膈下游离气体影的是
A. 急性胃穿孔
B. 肠梗阻
C. 肠套叠
D. 肝破裂
E. 结肠肿瘤

正确答案：A。急性胃穿孔

解析：立位X线透视可见膈下游离气体影的是急性胃穿孔（A对），急性胃穿孔后，少量气体进入腹腔内，X线检查可见新月形气体影。肠梗阻（B错）X线表现为气胀肠袢和液平面。肠套叠（C错）X线表现为“杯口征”。肝破裂（D错）X线表现为肝右膈升高，肝正常外形消失。结肠肿瘤（E错）X线检查最初可出现肠壁僵硬、黏膜破坏，随之可见恒定的充盈缺损、肠管腔狭窄等。